常见的可引起先天性婴儿畸形的病毒是
A. 风疹病毒
B. 麻疹病毒
C. 狂犬病毒
D. 脊髓灰质炎病毒
E. EB病毒

正确答案：A。风疹病毒